根据一项包括50例病例和50例对照的调查结果，两组关于可能病因因素分布的差异没有统计学意义，可以据此得出结论
A. 这个差异可能是抽样误差所致
B. 病例和对照组的可比性已被证实
C. 观察者或调查者的偏性已被消除
D. 该因素与疾病可能有联系
E. 这个差异临床上可能是显著的

正确答案：A。这个差异可能是抽样误差所致

解析：样本之间存在差异有两种可能，一是总体间本无差异，样本间的差异是由抽样误差所致，二是总体间固有差异，即非抽样误差造成的差异。统计学的假设检验就是用来判断这种差异属于哪种情况，当差异有统计学意义时，则认为按当前的检验水准，可认为差异为总体间固有差异，当差异没有统计学意义时，则认为按当前的检验水准，还不能认为总体间固有差异，样本间的差异可能是抽样误差所致（A对）。